丘疹、水疱、结痂同时存在，此为
A. 麻疹
B. 幼儿急疹
C. 风疹
D. 猩红热
E. 水痘

正确答案：E。水痘

解析：水痘皮疹特点：①初为红斑疹，数小时后变为深红色丘疹，再经数小时发展为疱疹。②皮疹呈向心分布，先出现于躯干和四肢近端，继为头面部、四肢远端，手掌、足底较少。③水痘皮疹先后分批陆续出现，每批历时1～6天，皮疹数目为数个至数百个不等。同一时期常可见斑、丘、疱疹和结痂同时存在。④疱疹持续2～3天后从中心开始干枯结痂，再经数日痂皮脱落，一般不留疤痕。故丘疹、水疱、结痂同时存在的是水痘（E对）。麻疹（A错）是小儿时期常见的一种急性呼吸道传染病，临床以发热、上呼吸道炎症、结膜炎、麻疹黏膜斑及全身斑丘疹为特征，无丘疹、水疱、结痂同时存在的皮疹特征。幼儿急疹（B错）又称婴儿玫瑰疹，其典型临床表现是：发热持续3～5天，体温多达39℃或更高，但全身症状较轻；热退后出疹，皮疹为红色斑丘疹，迅速遍布于躯干及面部，2～3天皮疹消失，无色素沉着及脱屑，无丘疹、水疱、结痂同时存在的皮疹特征。风疹（C错）临床以发热，皮疹及耳后、枕后、颈部淋巴结肿大为特征，无丘疹、水疱、结痂同时存在的皮疹特征。猩红热（D错）是由A组乙型溶血性链球菌感染后引起的急性发疹性呼吸道传染病，临床以发热、咽峡炎、全身弥漫性猩红色皮疹和疹退后皮肤脱屑为特征，无丘疹、水疱、结痂同时存在的皮疹特征。